《医疗器械监督管理条例》所称医疗器械，是指单独或者组合使用于人体的
A. 仪器、设备
B. 器具
C. 材料或者其他物品
D. 包括所需要的软件
E. 所有诊断试剂

正确答案：A、B、C、D。仪器、设备；器具；材料或者其他物品；包括所需要的软件